为地塞米松的衍生物，但比地塞米松抗炎作用强数百倍的是
A. 氟轻松
B. 布洛芬
C. 曲安奈德
D. 布地奈德
E. 倍氯米松

正确答案：E。倍氯米松